女，45岁，已经明确诊断为慢性牙周炎并经基础治疗4周后，左下6牙周袋探诊深度仍然为6mm，可探入颊侧根分叉区，牙龈无退缩，X-ray检查见根分叉处牙槽骨密度略有减低，则该患者最适宜做
A. 袋内壁刮治术
B. 翻瓣术
C. 隧道成形术
D. 截根术
E. 引导组织再生术

正确答案：E。引导组织再生术

解析：本题考查引导组织再生术的适应证。患牙根分叉处牙槽骨密度略有减低，可从颊侧探入根分叉区，牙龈无退缩，据此可判断为Ⅱ度根分叉病变。引导组织再生术（E对）是在牙周手术中利用膜性材料作为屏障，引导具有形成新附着能力的牙周膜细胞优先占领根面，从而在原已暴露于牙周袋内的根面上形成新的牙骨质，并有牙周膜纤维埋入，形成牙周组织的再生，适用于有足够牙龈高度的Ⅱ度根分叉病变，尤以下颌牙的Ⅱ度根分叉病变效果好。袋内壁刮治术（A错）是以最小的创伤，最大的组织保留，用手术刮治并彻底清除袋壁病变组织，但保留牙龈外壁的方法，适用于范围比较局限的三壁骨下袋和经过洁治、刮治依然存在的骨上袋，刮治术仅是去除病变组织，不能恢复根分叉区的骨缺损。翻瓣术（B错）是用手术方法切除部分牙周袋及袋内壁，并翻起牙龈的黏骨膜瓣，在直视下刮净牙石和肉芽组织，然后将牙龈瓣复位、缝合，适用于Ⅰ度根分叉病变的治疗，对于Ⅱ度根分叉病变需结合植骨术或引导组织再生术才能促使骨质新生以修复病损。隧道成形术（C错）是在牙成形术中，磨除牙颈部牙冠过突处和釉质突起，或在根柱较短的下颌磨牙根分叉处磨除牙体组织，以扩大根分叉开口处的方法，适用于骨质破坏较多，牙龈有部分退缩的根分叉病变患牙。截根术（D错）是指当多根牙的某一个根患有难以治愈的深牙周袋和骨吸收，或重度根分叉病变时，可将该患根切除，保留其余可保存的牙根及牙冠的方法，适用于牙周组织破坏严重，且有重度根分叉病变的患牙。